确定垂直距离时所用的息止（牙合）间隙平均值约为
A. 1mm
B. 2～3mm
C. 3～4mm
D. 4．5mm
E. 5mm

正确答案：B。2～3mm

解析：本题考查息止（牙合）间隙的平均值。在自然牙列存在时，当口腔不咀嚼、不吞咽、不说话时，下颌处于休息的静止状态，上下牙列自然分开，无（牙合）接触，叫做息止颌位，此时上下牙列间存在的间隙称息止（牙合）间隙，一般为2～3mm，因此确定垂直距离时所用的息止（牙合）间隙也应是2～3mm（B对）。